肱骨外上髁炎主要体征为
A. “4”字试验阳性
B. 伸肌腱牵拉试验（Mills）阳性
C. 杜加征（Dugas）阳性
D. 直腿抬高试验（Lasegue）阳性
E. 压头试验阳性

正确答案：B。伸肌腱牵拉试验（Mills）阳性

解析：肱骨外上髁炎的主要体征为伸肌腱牵拉试验（Mills）阳性（B对），即伸肘，握拳，屈腕，前臂旋前时，肘外侧出现疼痛。“4”字试验阳性（A错）多见于髋关节疾病，如髋关节结核等；杜加征（Dugas）阳性（C错）为肩关节脱位的典型体征；直腿抬高试验（Lasegue）阳性（D错）主要见于腰椎间盘突出症、梨状肌综合征等所致的坐骨神经损伤；压头试验阳性（Spurling征）（E错）为神经根型颈椎病的典型体征。